对真寒假热应采用的治疗方法是
A. 热因热用
B. 寒因寒用
C. 塞因塞用
D. 通因通用
E. 虚则补之

正确答案：A。热因热用

解析：本题考查正治与反治适用证，属于理解记忆内容。格阳证中，由于阴寒充塞于内，逼迫阳气浮越于外，故可见身反不恶寒，面赤如妆等假热之象，但由于阴寒内盛是病本，故同时也见下利清谷，四肢厥逆，脉微欲绝，舌淡苔白等内真寒的表现。因此，当用温热方药以治其本，故适用于真寒假热的治则是热因热用（A对，BCDE错）